下列各项，不属薄荷功效的是
A. 疏散风热
B. 疏肝行气
C. 清热凉血
D. 透疹利咽
E. 清利头目

正确答案：C。清热凉血

解析：该题考查薄荷的功效，属记忆内容。薄荷味辛性凉，归肺、肝经。其功效为疏散风热，清利头目，利咽透疹，疏肝行气（ABDE错C对）。